腺样囊性癌的病理特点是
A. 实性型中肿瘤细胞无变性坏死
B. 肿瘤间质不伴有玻璃样变
C. 肿瘤局限有包膜
D. 肿瘤细胞可形成小管状或条索状结构
E. 肿瘤细胞发生明显钙化

正确答案：D。肿瘤细胞可形成小管状或条索状结构

解析：本题考查腺样囊性癌的病理特点。腺样囊性癌的病理特点是肿瘤细胞可形成小管状或条索状结构（D对）。根据肿瘤细胞类型和排列方式分为以下三种组织类型：1.腺样（筛状）型：主要特点是肿瘤细胞团块内含有筛孔状囊样腔隙，与藕的断面相似。筛孔内充满嗜酸或嗜碱性黏液样物质，不均匀，呈网状，PAS染色弱阳性，阿辛蓝染色强阳性；有的囊样腔隙内为粉染的玻璃样变性的间质，腔隙周围有基底膜样结构。筛状结构为此瘤最典型和最常见的结构。2.管状型：主要特点是以肿瘤细胞形成小管状或条索状结构为主。3.实性型：此型细胞较小，胞质少，嗜碱性，核分裂象较多，肿瘤细胞排列成大小不等的上皮团，大的团块中心组织可变性坏死，管状和筛孔状结构较少。实性型通常比其他前类型容易复发和早期转移，预后不好。实性型中肿瘤细胞可变性坏死（A错）；肿瘤间质常有玻璃样变（B错）；肿瘤无包膜（C错），呈浸润性生长；肿瘤细胞无明显钙化（E错），通常透明。